患者，男性，33岁，有9年吸烟史。牙龈自动出血伴牙龈疼痛、口腔奇臭、不敢刷牙3天，无发热。检查：牙石（+++），龈缘呈虫蚀状，表面覆盖坏死伪膜，易于擦去。最可能的诊断是
A. 急性龈乳头炎
B. 增生性龈炎
C. 急性坏死性龈炎
D. 疱疹性龈口炎
E. 急性龈脓肿

正确答案：C。急性坏死性龈炎

解析：本题考查急性坏死性龈炎的诊断。患者，男性，有9年吸烟史（病因）。牙龈自动出血伴牙龈疼痛、口腔奇臭（腐败性口臭）、不敢刷牙3天，无发热。检查：牙石（+++），龈缘呈虫蚀状（龈缘坏死），表面覆盖坏死伪膜，易于擦去，根据牙龈疼痛、自发性出血、有腐败性口臭以及龈缘的坏死，并且有吸烟为诱因，可初步诊断为急性坏死性溃疡性龈炎（C对）。急性坏死性溃疡性龈炎的临床表现：1.好发人群：常发生于青壮年，以男性吸烟者多见。2.病程：本病起病急，病程较短，常为数天至1～2周。3.以龈乳头和龈缘的坏死为其特征性损害，尤以下颌前牙多见。龈缘如虫蚀状，坏死区出现灰褐色假膜，易于擦去，去除坏死组织后,其下为出血创面。4.患处牙龈极易出血，患者常诉晨起时枕头上有血迹，口中有血腥味，甚至有自发性出血。5.疼痛明显。6.有典型的腐败性口臭。急性龈乳头炎（A错）会出现牙齿间异物感，肿胀感，牙龈出血，牙龈糜烂等，一般不会有虫蚀状龈缘。增生性龈炎（B错）主要是牙龈的炎性肿胀，多发生于青少年。疱疹性龈口炎（D错）主要表现为口腔黏膜或牙龈上散在的多发的水疱，和本病例中的表现不符合。急性龈脓肿（E错）主要表现为牙龈疼痛，牙龈突起，牙龈流脓等，不符合本病例，故诊断应为急性坏死性龈炎。